SB与AB均升高见于
A. 急性呼吸性酸中毒
B. 慢性呼吸性酸中毒
C. 急性呼吸性碱中毒
D. 慢性呼吸性碱中毒
E. 酸碱平衡正常

正确答案：B。慢性呼吸性酸中毒

解析：正常人AB与SB相等（E错），当发生急性呼吸性酸中毒（A错）或急性呼吸性碱中毒（C错）时，由于准碳酸氢盐(SB)是标准化HCO3-后测量的数值，只受代谢因素影响，所以SB不变，但发生慢性呼吸性酸中毒（B对）或慢性呼吸性碱中毒（D错）时，由于肾的代偿作用，前者HCO3-继发性上升，导致SB和AB均上升，后者HCO3-继发性下降，导致SB和AB均下降。